浅层地下水含水层的位置是在地球的
A. 地表
B. 一个不透水层以上
C. 一个不透水层以下
D. 与泉水在同一个含水层
E. 位于溶洞内

正确答案：B。一个不透水层以上

解析：本题考查浅层地下水含水层的位置。浅层地下水是指潜藏在地表下第一个不透水层之上（B对ADE错）的地下水。深层地下水是指在第一个不透水层以下（C错）的地下水。